鱼肉中富含下列哪种营养素对脑发育有很好的作用
A. 赖氨酸
B. 膳食纤维
C. 亮氨酸
D. DHA和EPA
E. 有机酸

正确答案：D。DHA和EPA